初产妇，妊娠40周，产力正常，胎心140次/分，头位，双顶径10cm，先露浮，宫口2cm，对角径11cm，正确的处理是
A. 哌替啶肌注
B. 葡萄糖静点
C. 继续观察产程进展
D. 稀释缩宫素静点
E. 剖宫产

正确答案：E。剖宫产

解析：骨盆入口最短前后径并不是对角径和真结合径，而是产科结合径，此道无法用手指直接测出，可通过对角径减去2.5cm左右间接得出，正常值为10cm（P148）。该初产妇对角径11cm，通过对角径减去2.5cm左右间接得出产科结合径在8.5cm左右，而胎儿的双顶径10cm＞8.5cm，说明骨盆入口径狭窄，且先露浮，是剖宫产的手术指征（E对C错）。哌替啶肌注（P190）（A错）主要用于不协调性宫缩乏力，不是骨盆狭窄的正确处理。葡萄糖静点（B错）主要是用于快速恢复产妇体能。稀释缩宫素静点（P189）（D错）适用于协调性宫缩乏力或使不协调宫缩乏力恢复协调性。